基本药物目录遴选原则
A. 临床必需
B. 安全有效
C. 一线药物
D. 价格合理
E. 使用方便

正确答案：A、B、D、E。临床必需；安全有效；价格合理；使用方便

解析：本题考查基本药物目录遴选原则。国家基本药物遴选应当按照防治必需、安全有效（B对）、价格合理（D对）、使用方便（E对）、中西药并重、基本保障、临床必需（A对）和基层能够配备的原则，结合我国用药特点，参照国际经验，合理确定品种（剂型）和数量。一线药物（C错）是指首先考虑使用的药，不属于基本药物目录遴选原则。